连续用药后，病原体对药物的敏感性降低称为
A. 耐受性
B. 依赖性
C. 耐药性
D. 继发反应
E. 特异质反应

正确答案：C。耐药性

解析：本题考查耐药性。连续用药后，病原体对药物的敏感性降低称为耐药性（C对）。耐受性（A错）是指在连续用药过程中，有的药物的药效会逐渐减弱，需加大剂量才能显效的现象。药物依赖性（B错）指长期用药后，患者对药物产生主观和客观上需要连续用药的现象，分为躯体依赖性和精神依赖性。继发反应（D错）指药物的治疗作用所引起的不良后果，也称治疗矛盾。特异质反应（E错）指个体对一种药物发生有别于常人的特殊反应。